人类免疫缺陷病毒（HIV）不易传播的途径是
A. 性传播
B. 器官移植
C. 母婴传播
D. 生活接触
E. 不洁注射

正确答案：D。生活接触

解析：人类免疫缺陷病毒（HIV）目前公认的传播途径主要是性接触（A对）、血液接触（不洁注射等）（E对）和母婴传播（C对），以及接受HIV感染者的器官移植（B对）；不易传播的途径是生活接触（D错，为本题正确选项），例如拥抱等不会传播。